同时取头、面、胸、腹部腧穴，最适宜的体位是
A. 仰卧位
B. 俯卧位
C. 侧卧位
D. 俯伏坐位
E. 侧伏坐位

正确答案：A。仰卧位

解析：该题考查体位的选择。选择体位以既有利于正确定位，又便于针灸的施术操作和较长时间的留针而患者不致疲劳为原则，故仰卧位是同时取头、面、胸、腹部腧穴，最适宜的体位。（A对）。俯卧位适宜于头、项、脊背、腰骶部腧穴和下肢背侧及上肢部分腧穴（B错）。侧卧位适宜取身体侧面少阳经腧穴和上、下肢部分腧穴（C错）。俯伏坐位适宜于取后头和项、背部的腧穴（D错）。侧伏坐位适宜于取头部的一侧、面颊及耳前后部位的腧穴（E错）。